下列各项，属实证的临床表现是
A. 疼痛喜按
B. 五心烦热
C. 蒸蒸壮热
D. 精神委靡
E. 舌胖淡嫩

正确答案：C。蒸蒸壮热

解析：疼痛喜按属虚证（A错），疼痛拒按属实证。五心烦热属虚证（B错），蒸蒸壮热属实证（C对）。精神委靡属虚证（D错），精神亢奋属实证。舌胖淡嫩属虚证（E错），舌老苔腻属实证。